来源于上皮组织的恶性肿瘤是
A. 癌
B. 肉瘤
C. 母细胞瘤
D. 精原细胞瘤
E. 霍奇金病

正确答案：A。癌

解析：根据病变组织来源不同将恶性肿瘤分为癌和肉瘤。来源于上皮组织的恶性肿瘤是癌（A对），如鳞状细胞癌、腺癌、基底细胞癌等。来源于间叶组织的恶性肿瘤称肉瘤（B错），如脂肪肉瘤，横纹肌肉瘤等。母细胞瘤（C错）是指来源于幼稚组织的肿瘤，如神经母细胞瘤、髓母细胞瘤、肾母细胞瘤等。精原细胞瘤（D错）是来源于生殖细胞的恶性肿瘤，并非间叶组织。霍奇金病（E错）是恶性淋巴瘤的一种，发源于淋巴组织，而不是间叶组织。